男，68岁。痰中带血1个月。无发热，抗菌药物治疗无效。慢性支气管炎病史20年。查体：右下肺呼吸音减弱。该患者应首先考虑的诊断是
A. 支气管肺癌
B. 支气管扩张
C. 支气管哮喘
D. 肺结核
E. 肺血栓栓塞症

正确答案：A。支气管肺癌

解析：患者老年男性，痰中带血1个月（为中央型肺癌肿瘤向管腔内生长者常见症状，支气管扩张（B错）患者主要表现为慢性咳嗽、咯大量脓痰和（或）反复咯血，咯血量较大），抗菌药物治疗无效（支气管肺癌多数发热原因是由于肿瘤引起的阻塞性肺炎所致，抗生素治疗效果不佳），慢性支气管炎20年（肺癌发病因素），查体右下肺呼吸音减弱（肿瘤阻塞引起肺通气量降低或肺泡气体流量及流速降低所致），根据患者年龄、咯血量、病史和体征，首先考虑诊断为支气管肺癌（A对）（P77-P78）。支气管哮喘（P28）主要表现为与接触变应原、冷空气、上呼吸道感染、运动等有关的反复发作的喘息、气急、胸闷或咳嗽等症状，可在双肺闻及散在的或弥漫性、以呼气相为主的的哮鸣音，无咯血，与该患者病史、症状、体征不符（C错）。肺结核（P65）多有结核毒性症状，低热、盗汗、乏力。消瘦等，痰中带血虽是肺结核的常见可疑症状，但该患者缺少典型症状，不足以诊断肺结核（D错）。肺血栓栓塞症（P100）常见症状为不明原因的呼吸困难及气促，尤以活动后明显，咯血常为小量咯血，大咯血少见，体征以呼吸急促最多见，另有肺部哮鸣音和（或）细湿罗音或胸腔积液体征，该患者缺少相关诊断证据（E错）。